下列哪项是错误的
A. HAV属RNA病毒
B. HBV属DNA病毒
C. HCV属RNA病毒
D. HDV是缺陷病毒，属DNA病毒
E. HEV属RNA病毒

正确答案：D。HDV是缺陷病毒，属DNA病毒

解析：HDV是一种缺陷的嗜肝单链RNA病毒（D错，为本题正确答案），需要在HBV或其他嗜肝DNA病毒的辅助下才能复制增殖；HAV属RNA病毒（A对），其基因组为单股线状RNA；HBV属DNA病毒（B对），由不完全环状双链DNA构成；HCV属RNA病毒（C对），其基因组为单股正链RNA；HEV属RNA病毒（E对），其基因组同样为单股正链RNA。